典型的球窝关节
A. 肩关节
B. 桡腕关节
C. 拇指腕掌关节
D. 膝关节
E. 骶髂关节

正确答案：A。肩关节

解析：肩关节（A对）是典型的多轴球窝关节，桡腕关节（B错）是椭圆关节，拇指腕掌关节（C错）是鞍状关节，膝关节（D错）是屈戍关节，骶髂关节（E错）是平面关节。